因晶状体屈折力过强导致的近视称
A. 视力低下
B. 近视
C. 屈光性近视
D. 轴性近视
E. 调节紧张性近视

正确答案：C。屈光性近视